嗜肺军团菌最重要的传播途径是
A. 与患者接触
B. 消化道途径
C. 经呼吸道吸入染菌的气溶胶
D. 经烧伤创面感染
E. 医源性交叉感染

正确答案：C。经呼吸道吸入染菌的气溶胶